下列哪个组织中不能合成雌激素
A. 卵巢
B. 子宫
C. 胎盘
D. 黄体
E. 肾上腺皮质

正确答案：B。子宫